慢性化脓性骨髓炎主要X线表现是
A. 骨质硬化增生
B. 骨质破坏
C. 骨干增粗
D. 骨膜增厚
E. 骨皮质增厚

正确答案：A。骨质硬化增生

解析：慢性化脓性骨髓炎X线表现：可见到明显的修复。患骨虽有骨质修复、增生，但如未痊愈，则仍可见骨质破坏和死骨（A对）。急性骨髓炎有骨质破坏（B错），骨膜下脓肿的刺激，骨皮质周围出现骨膜增生（D错）。表现为一层密度不变的新生骨与骨干平行，骨膜新生骨围绕骨干的全部或大部形成包壳（C错）。急性骨髓炎局部骨皮质因失去营养而形成死骨（E错）。